苷类化合物可发生的化学反应有
A. 碱催化水解
B. 酶催化水解
C. 氧化反应
D. 醌化反应
E. 醚化反应

正确答案：A、B、C、E。碱催化水解；酶催化水解；氧化反应；醚化反应

解析：本题考查的是苷的化学反应。苷类化合物可发生的化学反应有碱催化水解（A对、酶催化水解（B对）、氧化反应（C对）与醚化反应（E对）。糖和苷的化学性质：（一）糖的化学性质：1.氧化反应：单糖分子中有醛（酮）基、伯醇基、仲醇基和邻二醇基结构单元。通常醛（酮）基最易被氧化，伯醇次之。2.羟基反应：糖和苷的羟基反应包括醚化、酰化、缩醛（缩酮）化以及与硼酸的络合反应等。3.羰基反应：除了发生上述氧化反应外，糖的羰基还可被催化氢化或金属氢化物还原，其产物叫糖醇。此外，具有醛或酮羰基的单糖可与苯肼反应，首先生成腙，在过量苯肼存在下α-羟基继续与苯肼作用生成脎。（二）苷键的裂解：1.酸催化水解：苷键具有缩醛结构，易为稀酸催化水解。2.碱催化水解：一般的苷键对稀碱应该相当稳定，不易被碱催化水解，但苷键具有酯的性质时，如苷元为酸、酚、有羰基共轭的烯醇类或成苷的羟基β-位有吸电子基取代者，遇碱就能水解。3.酶催化水解：酶促反应具有专属性高，条件温和的特点。用酶水解苷键可以获知苷键的构型，可以保持苷元结构不变，还可以保留部分苷键得到次级苷或低聚糖，以便获知苷元和糖、糖和糖之间的连接方式。（三）苷类的显色反应：苷类化合物由苷元和糖两部分组成，故苷类化合物能发生相应的苷元和糖的各种显色反应。